柴胡皂苷a的结构类型是
A. 乌苏烷型
B. 羊毛甾烷型
C. 齐墩果烷型
D. 达玛烷型
E. 羽扇豆烷型

正确答案：C。齐墩果烷型

解析：本题考查的是柴胡皂苷a的分类。柴胡皂苷a的结构类型是齐墩果烷型（C对）。柴胡中含有的总皂苷为1.6%～3.8%。柴胡中所含皂苷均为三萜皂苷，柴胡皂苷是柴胡的主要有效成分。《中国药典》以柴胡皂苷a和柴胡皂苷d为指标成分对柴胡药材进行含量测定。要求两者的总含量不少于0.30%。三萜：基本骨架由6个异戊二烯单位组成。三萜的种类很多，但以皂苷形式存在的三萜类型并不多，较为常见的有羊毛甾烷型、达玛烷型、齐墩果烷型、乌苏烷型和羽扇豆烷型，其中前两种属于四环三萜，后三种则属于五环三萜。1.四环三萜：结构与甾醇很类似。主要有以下类型。（1）羊毛甾烷型（B错），如猪苓酸A。（2）达玛烷型（D错），如20（S）-原人参二醇。2.五环三萜：主要有以下类型。（1）齐墩果烷型，此类以齐墩果酸最为多见。（2）乌苏烷型（A错），此类大多是乌苏酸的衍生物。（3）羽扇豆烷型（E错），如羽扇豆种子中存在的羽扇豆醇，酸枣仁中分得的白桦醇和白桦酸等。